关于上颌第一磨牙排列的位置，下列哪一项是正确的
A. 牙颈部略向近中倾斜
B. 颊尖离开（牙合）平面
C. 近中舌尖排在（牙合）平面上
D. 远中舌尖离开（牙合）平面
E. 以上均对

正确答案：E。以上均对

解析：上颌第一磨牙排列位置：近中与第二前磨牙接触，舌尖对应牙槽嵴顶连线，颈部微向近中和腭侧倾斜，近中舌尖与（牙合）平面接触，近中颊尖与远中舌尖高于（牙合）平面约1mm，远中颊尖高于（牙合）平面约1.5mm。掌握“全口义齿排牙及蜡型试戴”知识点。